效果最差的器械消毒方法是
A. 高压蒸汽灭菌法
B. 化学蒸汽压力灭菌法
C. 干热灭菌法
D. 酒精浸泡法
E. 碘伏表面消毒法

正确答案：D。酒精浸泡法

解析：本题考查效果最差的器械消毒方法。效果最差的器械消毒方法是酒精浸泡法（D对），高压蒸汽灭菌法（A错）、化学蒸汽压力灭菌法（B错）、干热灭菌法（C错）的灭菌效果较好，碘伏表面消毒法比酒精浸泡法的灭菌效果好（E错）。